能截疟的药有
A. 常山
B. 五倍子
C. 鸦胆子
D. 金荞麦
E. 生何首乌

正确答案：A、C、E。常山；鸦胆子；生何首乌

解析：本题考查的是涌吐药常山的功效。能截疟的药有常山（A对）、鸦胆子（C对）与何首乌（E对）。常山：【功效】涌吐痰饮，截疟。鸦胆子：【功效】清热解毒，燥湿杀虫，止痢截疟，腐蚀赘疣。生何首乌：【功效】补益精血，解毒，截疟，润肠通便。五倍子（B错）：【功效】敛肺降火，涩肠固精，敛汗止血，收湿敛疮。金荞麦（D错）：【功效】清热解毒，祛痰排脓，散瘀止痛。